女，28岁。婚后4年未孕，月经周期4～5天/2～3个月，量偏少，身高156cm，体重75kg，面部可见痤疮，阴毛分布呈男性型。妇科检查：子宫未见异常，双侧卵巢稍大。基础体温单相。该患者最可能的诊断是
A. 生殖器结核
B. 卵巢早衰
C. 子宫内膜异位症
D. 多囊卵巢综合征
E. 黄体功能不足

正确答案：D。多囊卵巢综合征

解析：成年女性患者，婚后4年未孕，月经周期4～5天（正常值3～7天）/2～3个月（正常值21～35天），量偏少，身高156cm，体重75kg，面部可见痤疮，阴毛分布呈男性型。妇科检查：子宫未见异常，双侧卵巢稍大。基础体温单相。可计算出该患者的BMI约为31，大于28，为肥胖。综合患者的症状、体征，该患者最可能的诊断是多囊卵巢综合征（D对）。生殖器结核（A错）多有结核感染史，有结核中毒的表现，多无痤疮表现。卵巢早衰（B错）表现为潮热多汗、面部潮红、性欲低下、闭经、不孕。子宫内膜异位症（C错）有继发性痛经且进行性加重、不孕或慢性盆腔痛，妇科检查扪及与子宫相连的囊性包块或盆腔内有触痛性结节。黄体功能不足（E错）多表现为月经周期缩短、月经频发、不孕或流产。